甲型肝炎的传播途径是
A. 注射、输血
B. 飞沫传播
C. 唾液传播
D. 粪-口传播
E. 垂直传播

正确答案：D。粪-口传播

解析：甲型、戊型肝炎以粪-口传播为主。掌握“病毒性肝炎”知识点。